急性肾炎患儿，肢体浮肿，咳嗽气急，心悸胸闷，口唇青紫，脉细无力。治疗应首选
A. 速尿加己椒苈黄丸
B. 速尿加龙胆泻肝汤
C. 西地兰加己椒苈黄丸
D. 西地兰加龙胆泻肝汤
E. 二氯嗪加己椒苈黄丸

正确答案：A。速尿加己椒苈黄丸

解析：据患儿在急性肾炎的基础上出现了咳嗽气急，心悸胸闷，口唇青紫，即有明显的循环充血，其治疗为严格卧床休息，限制水钠摄入量，使用强利尿剂（如速尿或利尿酸静脉滴注）；必要时加用酚妥拉明或硝普钠以减轻心脏前后负荷，经上述治疗仍未能控制者可行腹膜透析、血液滤过或血液透析，以及时迅速缓解循环的过度负荷。水气上逆，射肺凌心，肺失肃降，心失所养，则咳嗽气急，心悸胸闷；气为血之帅，气滞则血瘀，故口唇青紫；心阳虚衰，则脉细无力，故其证候为水凌心肺证，治以泻肺逐水，宁心安神，方药为己椒苈黄丸，故治疗应首选速尿加己椒苈黄丸（A对）。龙胆泻肝汤（B错）其功用为清泻肝胆实火，清利肝胆湿热，适用于肝胆实火上炎证或肝经湿热下注证。严重的循环充血是由于水钠潴留，血容量增加而致，并非正真的心力衰竭，西地兰为强心药（CD错）。二氯嗪（E错）其作用为松弛小动脉平滑肌，扩张血管，降低外周阻力而降压适应用于高血压危象、急进型高血压或高血压脑病。